与药物经济学相关性较小的学科是
A. 经济学
B. 决策学
C. 统计学
D. 流行病学
E. 生物化学

正确答案：E。生物化学